男，59岁。吞咽困难半年余，进行性加重，现只能进流食，并出现胸痛及咳嗽。该患者食管X线钡剂造影检查不可能出现的影像是
A. 食管造影时气道内出现造影剂
B. 食管下段呈鸟嘴症改变，边缘光滑
C. 局部食管腔扩张
D. 部分食管腔明显狭窄
E. 食管管壁僵硬，蠕动中断

正确答案：B。食管下段呈鸟嘴症改变，边缘光滑

解析：患者中老年男性，吞咽困难半年余，进行性加重，现只能进流食，并出现胸痛及咳嗽。中晚期食管癌的典型症状为进行性吞咽困难，先是难咽干的食物，继而半流质，最后水和唾液也不能咽下。病人逐渐消廋、脱水、无力，持续胸痛或背痛表示癌已侵犯食管外组织，最可能的诊断为食管癌。食管吞钡双重对比造影可见食管造影时气道内出现造影剂（A对）；局部食管腔扩张（C对）；部分食管腔明显狭窄（D对）；食管管壁僵硬，蠕动中断（E对）。食管下段呈鸟嘴症改变，边缘光滑（B错，为本题正确答案）多见于贲门失弛缓症。